女性，40岁。左乳房外上象限4cm×3cm肿块，距乳头距离5cm，可推动，但是病人双手叉腰时肿块活动度明显受限，左腋窝未扪及肿大淋巴结。该病人若确诊为乳腺癌，方式应选择
A. 乳腺癌根治术
B. 乳腺癌扩大根治术
C. 保留胸大、小肌的乳腺癌改良根治术
D. 保留胸大肌、切除胸小肌的乳腺癌改良根治术
E. 保留乳房的乳腺癌切除术

正确答案：A。乳腺癌根治术

解析：40岁女性患者。左乳房外上象限4cm×3cm肿块（T₂：＞2cm，≤5cm），距乳头距离5cm，可推动，但是病人双手叉腰时肿块活动度明显受限（提示与胸肌有黏连），左腋窝未扪及肿大淋巴结（N₀：同侧腋窝无肿大淋巴结）。根据患者的临床表现、查体，该患者乳腺癌属于临床Ⅱ期（T₂N₀M₀）。患者双手叉腰时肿块活动度明显受限，说明肿瘤与胸肌筋膜或胸肌有黏连，故应行乳腺癌根治术（A对），而不宜选用保留胸大肌、胸小肌的乳癌改良根治术（CD错）。乳腺癌扩大根治术（B错）主要适用于胸骨旁淋巴结转移者。保留乳房的乳腺癌切除术（E错）适用于强烈要求保留乳房的I、II期患者，肿瘤小于3~4cm，位于乳腺周围，而且淋巴结无明确肿大的患者。